A1DS呼吸系统常见的并发症是
A. 隐孢子虫感染
B. 隐球菌感染
C. 肺孢子菌感染
D. 口腔毛状白斑
E. 巨细胞病毒感染

正确答案：C。肺孢子菌感染

解析：艾滋病病毒感染者进入临床发病期后，会出现各种严重机会性感染和肿瘤。其中出现在呼吸系统最常见的感染是人肺孢子菌引起的肺孢子菌肺炎（C对），不仅是艾滋病患者所有的机会性感染中最常见的一种，也是患者最主要的死因。其病原体是耶氏肺孢子菌，是一种真菌。患者常见的临床表现为高热、呼吸急促、口唇发绀，伴有严重缺氧及呼吸衰竭。另外结核杆菌也是艾滋病患者最常合并的肺部感染菌种，也是其主要死因之一。隐孢子虫感染是A1DS消化系统常见的并发症（A错）。隐球菌侵犯中枢神经系统引起感染（B错）。口腔毛状白斑侵犯口腔引起感染（D错）。巨细胞病毒和弓形虫性视网膜炎，巨细胞病毒（CMV）感染是艾滋病患者最常见的疱疹病毒感染（E错）。